中医学认为，系统性红斑狼疮后期的主要病机是
A. 阴虚内热
B. 气阴两伤
C. 阳气亏虚
D. 阴阳两虚
E. 阴虚血瘀

正确答案：D。阴阳两虚

解析：系统性红斑狼疮起于先天禀赋不足，肝肾亏虚，精血不足，或情志内伤，劳倦过度，或日光暴晒，或药物所伤等，导致热毒入里，燔灼阴血，瘀血阻络（E错），血脉不通，皮肤受损，渐及关节、筋骨，脏腑而成。急性发病期以热毒炽盛，热郁积饮，瘀热互结，经络闭阻等实证为主。待高热退后，或屡用激素类药物，则渐出现阴虚内热（A错），或气阴两虚（B错），肝肾阴虚，发病日久，阴损及阳，出现脾肾阳虚（C错），渐至阴阳俱虚（D对）。